麝香中具有强烈特异香气的主要活性成分是
A. 雄性酮
B. 麝香酮
C. 麝香吡啶
D. 尿囊素
E. 胆甾醇

正确答案：B。麝香酮

解析：本题考查的是麝香的化学成分。麝香具有特异强烈香气的活性成分是麝香酮（B对）。麝香的化学成分较为复杂，其中麝香酮（L-3-甲基十五环酮）是天然麝香的有效成分之一。《中国药典》以麝香酮为指标成分进行含量测定，要求麝香酮含量不得少于2.0%。此外，麝香中还含有降麝香酮，麝香吡啶（C错）和羟基麝香吡啶A、B等10余种雄甾烷衍生物，而且还有多肽、脂肪酸、胆甾醇（E错）及其酯和蜡等。雄性酮（A错）与尿囊素（D错），2022年考试指南未明确说明。